知觉是人脑对客观事物
A. 个别属性的反映
B. 整体属性的反映
C. 本质属性的反映
D. 特殊属性的反映
E. 发展属性的反映

正确答案：B。整体属性的反映